幼年期生长素过少会出现
A. 呆小症
B. 巨人症
C. 侏儒症
D. 库欣（Cushing）综合征
E. 艾迪生（Addison）病

正确答案：C。侏儒症